氨茶碱与碳酸氢钠伍用属于
A. 吸收的相互作用
B. 分布的相互作用
C. 代谢的相互作用
D. 排泄的相互作用
E. 消除的相互作用

正确答案：A。吸收的相互作用